皮肤的物理辐射散热速度决定于
A. 皮肤血流速度
B. 环境温度和湿度
C. 皮肤温度和环境温度
D. 空气对流速度
E. 皮肤温度和环境湿度

正确答案：C。皮肤温度和环境温度

解析：皮肤的物理辐射散射速度决定于皮肤温度和环境温度（C对E错）的差值。当皮肤温度高于环境温度时，温度差越大，辐射散热量就越多速率就越快，反之，温度差越小，辐射散热量就越少，速率就越小。若环境温度高于皮肤温度，则机体不仅不能通过辐射散热，反而将吸收周围环境中的热量。皮肤的血流速度（A错）（与皮肤温度的高低有关）与环境的温度和湿度（B错），均不能代表皮肤温度与环境温度的差值。空气的对流速度（D错）影响皮肤的对流散热。